反射弧中，哪个环节最易疲劳
A. 中枢
B. 感受器
C. 效应器
D. 传入神经纤维
E. 传出神经纤维

正确答案：A。中枢